患者，男，49岁。小便开始或末尾尿液混浊，色如米泔，小便不畅，舌质淡，苔薄黄，脉象弦滑首选药物是
A. 木通
B. 茯苓
C. 萆薢
D. 车前子
E. 泽泻

正确答案：C。萆薢

解析：萆薢性味苦平，归肾、胃经，其功效为利湿去浊，祛风除痹。可治疗膏淋，白浊，白带过多；风湿痹痛，关节不利，腰膝疼痛。为治膏淋要药（C对）。木通的功效为利尿通淋，清心除烦，通经下乳。治疗淋证，水肿；心烦尿赤，口舌生疮；经闭乳少，湿热痹痛（A错）。茯苓的功效为利水渗湿，健脾，宁心安神。治疗水肿尿少；痰饮眩悸；脾虚食少，便溏泄泻；心神不安，惊悸失眠（B错）。车前子的功效为清热利尿通淋，渗湿止泻，明目，祛痰。治疗热淋涩痛，水肿胀满；暑湿泄泻；目赤肿痛，目暗昏花；痰热咳嗽（D错）。泽泻的功效为利水渗湿，泄热，化浊降脂。治疗水肿胀满，小便不利，泄泻尿少，痰饮眩晕；热淋涩痛，遗精；高脂血症（E错）。